治寒热往来、胸胁苦满的成药是
A. 小柴胡颗粒
B. 柴胡口服液
C. 午时茶颗粒
D. 香石双解袋泡剂
E. 银翘解毒颗粒

正确答案：A。小柴胡颗粒